10个月男孩，诊断为流感嗜血杆菌脑膜炎，经抗生素治疗1周后，病情好转，体温正常，近2天又出现发热，搐搦，前囟饱满，颅缝分离，应首先考虑的诊断是
A. 脑膜炎复发
B. 脑膜炎后遗症
C. 脑脓肿
D. 脑水肿
E. 硬膜下积液

正确答案：E。硬膜下积液

解析：硬膜下积液好发于1岁以下的婴儿，多见于流感嗜血杆菌、肺炎链球菌所致的脑膜炎。本例患儿在化脑治疗过程中体温退而复升、惊厥、颅内压增高（前囟饱满、颅缝分离），应考虑诊断为硬膜下积液（E对）。脑膜炎复发不会如此迅速出现（A错）。脑膜炎后遗症系患急性脑膜炎经治疗后遗留下手足震颤、反应迟钝、记忆力减退等病症（B错）。脑脓肿大多继发于颅外感染（C错）。脑水肿晚期常出现落日眼，神经精神症状逐渐加重（D错）。